与气机升降调节关系密切的是
A. 肺与肝
B. 肺与脾
C. 心与肺
D. 心与肾
E. 脾与肝

正确答案：A。肺与肝

解析：肺与肝的关系，主要体现在调节人体气机升降方面（A对）。“肝生于左，肺藏于右”，是对肝肺气机升降特点的概括。肝主疏泄，调畅气机，肝气以升发为宜；肺主气，调节气机，肺气以肃降为顺。肝升肺降，一升一降，升降协调，对全身气机调畅、气血调和，起着重要的调节作用；肺与脾的关系，主要表现在气的生成与津液代谢两个方面（B错）；心与肺的关系主要体现为气与血的关系（C错）；心与肾的关系主要表现为水火既济、精神互用、君相安位等方面（D错）；脾与肝的关系主要表现在疏泄与运化的相互为用、藏血与统血的相互协调关系方面（E错）。